哪种疾病咳嗽并咳大量痰液
A. 急性咽喉炎
B. 支气管扩张
C. 急性支气管炎
D. 胸膜炎
E. 肺结核

正确答案：B。支气管扩张